有梳状肌的区域是
A. 左心耳、右心耳
B. 左心房、左心室
C. 固有心房、腔静脉窦
D. 右心房、右心室
E. 左、右心房和左、右心室

正确答案：A。左心耳、右心耳

解析：左心耳、右心耳（A对）为有梳状肌的区域，且左心耳梳状肌没有右心耳发达且分布不匀。